抗心律失常药胺碘酮可致的主要用药风险是
A. 心脏毒性（折返心律和传导阻滞）
B. 肺毒性（间质性肺炎）
C. 血液毒性（骨髓造血功能障碍）
D. 耳毒性（耳聋）
E. 肾毒性（血肌酐升高）

正确答案：B。肺毒性（间质性肺炎）

解析：本题考查胺碘酮的不良反应。胺碘酮为延长动作电位时长的抗心律失常药，常见的不良反应为肺毒性（B对）。